眼副器包括
A. 眼睑、结膜、泪器、眼肌、眶脂体和眶筋膜
B. 结膜、睫状体、泪器和眼肌
C. 眼睑、眶脂体、睫状体和泪器
D. 眼睑、结膜和眼肌
E. 蜗窗

正确答案：A。眼睑、结膜、泪器、眼肌、眶脂体和眶筋膜

解析：眼副器包括眼睑、结膜、泪器、眼肌、眶脂体和眶筋膜（A对）。